男，24岁。既往健康，某日坐火车出差出站后突然感到周围气氛不对，感觉站内的人对自己充满敌意，周围的人都用异样的眼光观察自己。该患者属于
A. 原发性妄想
B. 幻觉
C. 错觉
D. 思维奔逸
E. 感知综合障碍

正确答案：A。原发性妄想

解析：该患者既往健康，某日坐火车出差出站后突然感到周围气氛不对，感觉站内的人对自己充满敌意，周围的人都用异样的眼光观察自己（内容不可理解，不能用既往经历、当前处境及心理活动解释），该患者属于原发性妄想（A对）。幻觉是没有现实刺激作用于感觉器官时出现的知觉体验，是一种虚幻的知觉（B错）。错觉是对客观事物歪曲的知觉，多表现为错视和错听，并常带有恐怖色彩，如患者把输液管看成一条正在吸血的蛇等（C错）。思维奔逸患者表现为特别健谈，说话滔滔不绝，口若悬河，感到脑子特别灵活，就像机器加了“润滑油”一样难以停顿下来”（D错）。感知综合障碍是指患者对客观事物的整体属性能够正确感知，但对某些个别属性如大小、形状、颜色、距离、空间位置等产生错误的感知（E错）。